药品经营企业必须具有
A. 自有运输车辆
B. 质量检验机构
C. 购进商品检验仪器设备
D. 质量管理制度
E. 质量管理机构

正确答案：D。质量管理制度

解析：本题考查药品经营质量管理规范。药品经营企业必须具有质量管理制度（D对）。《药品经营质量管理规范》（GSP）是药品经营管理和质量控制的基本准则，其目的是通过药品流通的全过程质量管理，规范药品经营行为，保障人体用药安全、有效，是药品经营企业必须具备的质量管理制度。